（牙合）检查时应检查以下内容，除了
A. 牙列是否完整
B. 有无拥挤错位覆（牙合）、覆盖关系
C. 覆（牙合）、覆盖关系是否正常
D. （牙合）的类型
E. 夜磨牙习惯

正确答案：E。夜磨牙习惯

解析：本题考查（牙合）的检查内容。（牙合）检查时应检查以下内容，除了夜磨牙习惯（E错，为本题的正确答案）。夜磨牙习惯的有无需要通过对患者的问诊才能得知，不是（牙合）检查的内容。牙周病患者（牙合）检查的内容包括：第一、正中（牙合）。检查时观察下颌位置是否在正中位，上下颌牙是否达到最广泛且密切接触的（牙合）关系，属于何种（牙合）的类型（D对）。上下前牙的中线是否一致，牙排列是否正常，有无拥挤错位（B对）、扭转等错（牙合）。覆（牙合）、覆盖关系是否正常（C对），有无深覆（牙合）、深覆盖或反（牙合）、对刃（牙合）、锁（牙合）等。第二、检查（牙合）磨耗程度是否均匀。第三、检查牙列是否完整（A对），有无牙松动或移位、牙缺失或牙倾斜等。